关于儿茶酚胺与α受体结合后产生的效应，下列哪项错误
A. 血管收缩
B. 妊娠子宫收缩
C. 扩瞳肌收缩
D. 小肠平滑肌收缩
E. 竖毛肌收缩

正确答案：D。小肠平滑肌收缩